无实验室检查结果时，根据中毒的流行病学特点和病人的临床表现，能否初步判断食物中毒
A. 视情况而定
B. 不可以
C. 可以
D. 上级部门决定
E. 专家讨论后决定

正确答案：C。可以